国际癌症研究所（IARC）将环境因子和类别、混合物及暴露环境与人类癌症的关系分为4组，错误的是
A. 是人类的致癌物
B. 是人类的间接致癌物
C. 是人类的很可能或可能致癌物
D. 现有的证据不能对人类的致癌性进行分类
E. 对人类可能是非致癌物

正确答案：B。是人类的间接致癌物